多奈哌齐的药理作用特点是
A. 对中枢单胺氧化酶选择性高，使脑内DA降解减少
B. 对中枢胆碱酯酶选择性高，使脑内Ach增加
C. 对外周胆碱酯酶选择性高，使突触部位Ach大量增加
D. 对中枢GABA转氨酶选择性高，使脑内GABA分解减少
E. 对外周单胺氧化酶选择性高，使肾上腺素分解减慢

正确答案：B。对中枢胆碱酯酶选择性高，使脑内Ach增加

解析：本题考查多奈哌齐。多奈哌齐为乙酰胆碱脂酶抑制剂，通过抑制胆碱酯酶活性，阻止乙酰胆碱的水解，提高脑内乙酰胆碱的含量（B对），从而缓解因胆碱能神经功能缺陷所引起的记忆和认知功能障碍。